按照斗谱编排基本原则，因外观形状相似但功效不同，不能排列在一起的饮片是
A. 板蓝根与大青叶
B. 阿魏与鸡矢藤
C. 陈皮与青皮
D. 山药与天花粉
E. 麻黄与麻黄根

正确答案：D。山药与天花粉

解析：本题考查的是斗谱排列时还应参考的其他原则。按照斗谱编排基本原则，因外观形状相似但功效不同，不能排列在一起的饮片是山药与天花粉（D对）。中药斗谱应根据中药的性能和中医处方用药的配伍规律以及医院饮片品种和使用频率、医院专科设置、医院用药特色、医师用药习惯等情况，按照知识性、科学性和方便性、安全性的原则进行设计，合理有序地存放。斗谱编排是否科学、合理，直接影响配方效率和质量，但一般都是根据各药使用的不同频率以及药物的性质而安排的。1.斗谱编排基本原则：（1）按饮片使用频率排序。常用药物应放在斗架的中上层，便于调剂操作。（2）按饮片的质地轻重排序。质地较轻且用量较少的药物，应放在斗架的高层。质地沉重的矿石、化石、贝壳类药物和易于造成污染的药物（如炭药），多放在斗架的较下层。质地松泡且用量较大的药物，多放在斗架最低层的大药斗内。（3）按饮片药用部位或功效排列。（4）将同一处方中经常一起配伍应用的，如“相须”“相使”配伍的饮片、处方常用的“药对”药物可同放于一个斗中。如陈皮、青皮（C错）；板蓝根、大青叶（A错）等。2.斗谱排列时还应参考的其他原则：有些药物放在一起可能会造成意外事故的发生，因此在摆放时应注意以下几点：（1）属于配伍禁忌的药物，不能装于一斗或上下药斗中。（2）外观性状相似的饮片，尤其是外观形状相似但功效不同的饮片，不宜排列在一起。如山药与天花粉等。（3）药名相近，但性味功效不同的饮片不应排列在一起。（4）同一植物来源但不同部位入药的并且功效不相同的饮片不能排列在一起，如麻黄与麻黄根（E错）。（5）为防止灰尘污染，有些中药不宜放在一般的药斗内，而宜存放在加盖的瓷罐中，以保持清洁卫生。（6）有恶劣气味的药物，不能与其他药物装于一个药斗中。如阿魏、鸡矢藤（B错）等。（7）贵细药品（价格昂贵或稀少的中药）不能存放在一般的药斗内，应设专柜存放，由专人管理，每天清点账物。（8）毒性中药和麻醉中药应按照有关规定存放，绝不能放于一般药斗内，必须专柜、专锁、专账、专人管理，严防意外事故的发生。